男性患者，42岁，突发上腹剧痛2小时，蔓延至右下腹及全腹，既往有胃痛病史10余年，未诊治，查体：板状腹，压痛反跳痛，肝浊音界消失，非手术治疗中最重要的措施是
A. 止痛
B. 胃肠减压
C. 抗生素治疗
D. 洗胃
E. 低压灌肠

正确答案：B。胃肠减压

解析：青年男性患者，有胃痛病史，2小时前突发上腹剧痛，腹部压痛、反跳痛，板状腹（腹膜刺激征，提示急性腹膜炎），肝浊音界消失（提示空腔脏器破裂），结合患者病史、体查，应考虑为急性消化性溃疡穿孔。症状和体征较轻的患者，可采用非手术治疗，治疗措施包括：①禁食、持续胃肠减压；②输液以维持水、电解质平衡并给予营养支持；③应用抗生素以防治感染；④静脉应用抑酸药；⑤酌情应用镇静、止痛药物等，其中最紧急、最重要的治疗措施是胃肠减压（B对AC错），因为胃肠减压可以抽出胃内容物和气体，减少胃内容物外漏，改善胃壁的血运，有利于炎症的吸收和穿孔的闭合。洗胃（D错）主要用于经口摄入各种有毒物质（如农药、过量药物）的患者，其目的是清除胃内未被吸收的毒物或清洁胃腔。低压灌肠（E错）可刺激肠蠕动，软化大便，排出肠道内的气体，减轻腹胀，主要用于解除便秘或胃肠道手术的术前准备。